美国药典的缩写是
A. BP
B. ChP
C. JP
D. pH.Eur.
E. USP

正确答案：E。USP

解析：本题考查药典。美国药典的缩写是USP（E对）。《美国药典》缩写为USP；BP（A错）是英国药典的缩写；ChP（B错）是中国药典的缩写；JP（C错）是日本药典的缩写；Ph.Eur.（D错）是欧洲药典的缩写。